某自来水厂工人，在工作时因接触某种有毒气体，出现头晕、胸闷和呼吸困难，并伴吐粉红色泡沫痰。X线胸透：肺纹理增粗，两肺散在大小不等的网状阴影，边缘模糊。考虑是哪种气体中毒
A. 氯气
B. 氰化氢
C. 二氧化碳
D. 一氧化碳
E. 甲烷

正确答案：A。氯气

解析：本题考查氯气中度中毒症状。当氯气（A对BCDE错）中毒时，会产生刺激反应，出现一过性眼和上呼吸道黏膜刺激症状。当发展至中度中毒时，表现为支气管肺炎、间质性肺水肿或局限性肺泡性水肿或哮喘样发作。咯粉红色泡沫痰或痰中带血，伴有神经系统症状和胃肠道反应。X线表现肺纹理增多模糊，肺门阴影增宽境界不清，两肺散在点状阴影和网状阴影，有时可见支气管袖口征及克氏B线。